我国艾滋病防治工作坚持的方针是
A. 预防为主，防治结合
B. 政府领导，全社会共同参与
C. 宣传教育，行为干预
D. 行为干预，关怀救助
E. 统一协调，综合防治

正确答案：A。预防为主，防治结合

解析：艾滋病防治工作坚持预防为主、防治结合的方针，建立政府组织领导、部门各负其责、全社会共同参与的机制，加强宣传教育，采取行为干预和关怀救助等措施，施行综合防治。掌握“艾滋病的预防与控制、治疗与法律责任”知识点。